作用于微管的抗肿瘤药物是
A. 来曲唑
B. 依托泊苷
C. 卡莫氟
D. 紫杉醇
E. 顺铂

正确答案：D。紫杉醇

解析：本题考查作用于微管的抗肿瘤药物。紫杉醇（D对）的抗肿瘤作用机制是通过诱导和促使微管蛋白聚合成微管，同时抑制所形成微管的解聚，从而抑制了细胞分裂和增殖；来曲唑（A错）为芳构酶抑制剂；依托泊苷（B错）为DNA拓扑异构酶Ⅱ抑制剂；卡莫氟（C错）为嘧啶类抗代谢药；顺铂（E错）是金属铂类络合物,属于细胞周期非特异性抗肿瘤药。